可吸入颗粒物是指大气中粒径的颗粒物
A. ≤100μm
B. ≤10μm
C. ≤2.5μm
D. ≤0.1μm
E. ≥1μm

正确答案：B。≤10μm

解析：本题考查可吸入颗粒物。可吸入颗粒物指空气动力学直径≤10μm（B对ACDE错）的颗粒物，因其能进入人体呼吸道而命名之，又因其能够长期漂浮在空气中，也被称为飘尘。